患者因左下后牙有洞，要求治疗。检查：左下6近中邻（牙合）面深龋洞，探敏，叩（-），冷测一过性敏感，该牙诊断为深龋。处理为
A. 银汞合金充填
B. 聚羧酸锌水门汀充填
C. 聚羧酸锌水门汀垫底、银汞合金充填
D. 玻璃离子水门汀充填
E. 牙髓治疗

正确答案：C。聚羧酸锌水门汀垫底、银汞合金充填

解析：本题考查龋病的治疗。患者因左下后牙有洞，要求治疗。检查：左下6近中邻（牙合）面深龋洞，探敏，叩（-），冷测一过性敏感，该牙诊断为深龋。处理为聚羧酸锌水门汀垫底、银汞合金充填（C对）。深的龋洞，距离髓腔近，充填时应垫底以隔绝外界刺激，以免激惹牙髓，然后做银汞合金充填（C对A错）。下颌第一磨牙承受的咬合力较大，聚羧酸锌水门汀或玻璃离子水门汀，强度不够，不能做为下颌第一磨牙的永久充填材料（BD错）。患牙诊断为深龋，探敏，叩（-），冷测一过性敏感，没有牙髓病变，不必做根管治疗（E错）。